患儿，6岁。寒战，发热，头痛，身痛，无汗，鼻流清涕，喷嚏，咳嗽，喉痒，咽不红，舌苔薄白，脉浮紧。治疗应首选
A. 新加香薷饮
B. 荆防败毒散
C. 杏苏散
D. 桑菊饮
E. 葱豉汤

正确答案：B。荆防败毒散

解析：患儿发热、鼻塞清涕，喷嚏，咳嗽，喉痒，咽不红当属风寒感冒，风寒之邪，郁于腠理，致使肌肤闭郁，卫阳不得宣发，导致寒战、发热、无汗，肺气失宣，则致鼻塞、流涕、咳嗽，寒邪郁于太阳经脉，经脉拘急收引，则致头痛、身痛，舌苔薄白，脉浮紧为风寒感冒之象，治以荆防败毒散，可辛温解表（B对）。新加香薷饮主治暑邪感冒，症见发热，头痛，身重困倦，食欲不振，舌红，苔黄腻（A错）。杏苏散适于凉燥伤肺证，症见恶寒无汗，咳嗽痰稀，鼻塞咽干，苔白脉弦（C错）。桑菊饮适于风热犯肺所致的感冒，见咳嗽，身热不甚，口微渴，苔薄白，脉浮数者（D错）。葱豉汤适于风寒感冒轻证，见恶寒发热，无汗，头痛鼻塞者（E错）。